无内分泌干扰效应的污染物是
A. 苯酚
B. 多氯联苯
C. 邻苯二甲酸酯
D. 铝
E. 二噁英

正确答案：D。铝

解析：本题考查环境内分泌干扰物的相关内容。已被证实或疑为具有内分泌干扰作用的环境化学物质有数百种，苯酚（A对）、多氯联苯（B对）、邻苯二甲酸酯（C对）、二噁英（E对）均属于环境内分泌干扰物。铝（D错，为本题正确答案）不是重金属，无内分泌干扰效应。